上述属于医生违背不伤害原则的是
A. 医生对病人的呼叫或提问给予应答
B. 医生的行为使某个病人受益，但却给别的病人带来了损害
C. 妊娠危及母亲的生命时，医生给予引产
D. 医生给病人实施粗暴性的检查
E. 医生尊重病人是指满足病人的一切要求

正确答案：D。医生给病人实施粗暴性的检查

解析：不伤害原则是指在医务人员的整个医疗行为中，无论动机，还是效果，均应避免对病人造成伤害，医生给病人实施粗暴性的检查（D对）对病人造成了伤害，违背了不伤害原则。医生的行为使某个病人收益，但却给别的病人带来了损害（B错），属于违背有利原则。医生对病人的呼叫或提问给予应答（A错）；妊娠危及母亲的生命时，医生给予引产（C错），遵守了不伤害原则。尊重原则是指医务人员尊重病人的伦理原则，尊重原则的合理性源于病人享有人格尊严和医疗自主权，但其实现取决于医务人员对其合理性的认同以及医患之间平等关系的认可和构建，并不是指满足病人的一切要求（E错）。